关于噬菌体的化学组成，说法错误的是
A. 大多数呈蝌蚪形
B. 不具有抗原性
C. 由头部和尾部组成
D. 能识别宿主菌细胞表面特殊受体
E. 含有遗传物质DNA或RNA

正确答案：B。不具有抗原性

解析：噬菌体的化学组成：大多数噬菌体呈蝌蚪形，其头部衣壳和尾部的化学组成是蛋白质且具有抗原性，头部衣壳内含有噬菌体的遗传物质即DNA或RNA，尾部有能识别宿主菌细胞表面的特殊受体，与噬菌体的吸附功能有关。掌握“噬菌体性状及分类”知识点。